女，36岁，4年前车祸外伤导致左股骨颈骨折，急诊行闭合复位螺钉内固定术，1年前逐渐出现左髋疼痛，行走时加重，髋部活动受限，最可能出现的情况是
A. 髋关节感染
B. 股骨头坏死
C. 股骨颈骨折不愈合
D. 骨关节炎
E. 股骨颈再次骨折

正确答案：B。股骨头坏死

解析：中年女性患者，有车祸外伤致股骨颈骨折史，股骨颈骨折为股骨头坏死（B对）的常见原因，患者出现髋部活动障碍为股骨头坏死的常见体征。髋关节感染（A错）急骤出现，不是逐渐出现，多发生高热，穿刺液检查可找到革兰阳性球菌。股骨颈骨折不愈合（C错）为治疗后超过一般愈合时间 (9个月），且再度延迟治疗（时间3个月），仍达不到骨性愈合，常因多次手术引起。骨关节炎（D错）多见于50岁以上的中老年人，最主要的病理变化发生在关节软骨，关节疼痛常与天气变化有关。股骨颈再次骨折（E错）多因暴力引起，不会逐渐出现。